有小毒，婴幼儿应慎用的药物是
A. 旋覆花
B. 款冬花
C. 紫菀
D. 白芥子
E. 杏仁

正确答案：E。杏仁

解析：该题考查杏仁的药性和使用注意。杏仁味苦，性微温。有小毒。使用时阴虚咳喘及大便溏泻者忌用。用量不宜过大，婴儿慎用（E对）。